为预防高血压，青少年膳食中每日钠盐摄入量最好不能高于
A. 2g
B. 3g
C. 4g
D. 5g
E. 6g

正确答案：D。5g